视网膜
A. 外层为视神经细胞层
B. 内层为色素上皮层
C. 盲部包括视网膜的睫状体部和虹膜部
D. 视神经盘是感光最敏锐的部位
E. 无

正确答案：C。盲部包括视网膜的睫状体部和虹膜部

解析：视网膜分两部，分别是视部和盲部，其中视网膜盲部包括无感光作用的虹膜部和睫状体部（C对）。视网膜也分两层，分别是外层的色素上皮层（A错）和内层的视神经细胞层（B错）。视神经盘因无感光细胞分布，故无感光功能，被成称为生理性盲点，而黄斑中央凹因无血管走行，且视锥细胞密集，故为感光最敏锐处（D错）。